某省药品监督管理部门在对辖区内药品批发企业甲（经营范围不包括中药饮片）实施监督检查时，发现甲的仓库储存作业区内存放有约2000套印有生产企业名称的为邻省中药饮片生产企业乙的中药饮片包装袋，以及已完成包装待封口的500余袋印有生产企业名称的为乙的疑似“中药饮片”半成品，现场有加工中药材的痕迹。甲的采购人员交代，加工“中药饮片”的原料药材系采购自本省中药材专业市场商户丙的中药材初加工产品，经仓库养护员直接套袋完成包装；甲的销售人员交代，约有20袋上述“中药饮片”成品销售给了本省药品零售企业丁。就有关情况，甲所在地省级药品监督管理部门与邻省药品监督管理部门进行了沟通。经邻省药品监督管理部门协查确认，乙确实存在向甲有偿提供其中药饮片包装袋的行为。对于甲在仓库内加工“中药饮片”的做法，药品监督管理部门认定的违法行为不包括
A. 甲不符合《药品生产质量管理规范》中关于中药饮片生产的要求
B. 甲不具各中药饮片经营范围
C. 甲未依法持有《药品生产许可证》
D. 甲未严格执行中药饮片炮制规范

正确答案：D。甲未严格执行中药饮片炮制规范

解析：本题考查中药材采收与产地加工费的主要内容。认定的违法行为不包括甲未严格执行中药饮片炮制规范（D错，为本题正确答案）。中药。饮片生产企业对采购的鲜切药材承担质量管理责任，对鲜切药材应当入库验收，按照中药饮片GMP要求和国家药品标准或者省（自治区、直辖市）中药饮片炮制规范进行净制、炮炙等生产加工，并经检验合格后，方可销售。从事制剂、原料药、中药饮片生产活动，申请人应当按照本办法和国家药品监督管理局规定的申报资料要求，向所在地省、自治区、直辖市药品监督管理部门提出申请（A对）。药品经营类别：药品经营类别是药品零售企业《药品经营许可证》载明事项之一，具体分为：处方药、甲类非处方药、乙类非处方药。从事药品零售审批时，药品监督管理部门应当先核定经营类别，并在经营范围中予以明确（B对）。药品经营许可，表现形式为颁发《药品经营许可证》（C对）。